4岁男孩，身高90cm，体重11Kg，皮肤较松弛，腹部皮下脂肪约0.3cm，该小儿的营养状况属
A. 正常
B. 轻度营养不良
C. 中度营养不良
D. 重度营养不良
E. 极重度营养不良

正确答案：C。中度营养不良

解析：营养不良的分度标准：Ⅰ度：体重低于正常15%～25%；腹壁皮下脂肪厚度0.8～0.4cm；身长尚正常；精神状态稍不活泼。Ⅱ度：体重低于正常25%～40%；腹壁皮下脂肪厚度0.4cm以下；身长低于正常；精神状态萎靡或烦躁不安。Ⅲ度：体重低于正常40%以上；腹壁皮下脂肪完全消失；身长明显低于正常；精神状态呆滞，反应低下，抑制与烦躁交替。根据“表2-1”（P9）可知，4岁男孩理想体重应为16kg，实际体重11kg，该患儿体重低于正常值的30%左右；理想身高应为103cm左右，实际身高为90cm；且皮肤较松弛，腹部皮下脂肪0.3cm，可诊断为中度营养不良（C对）。